男孩，1岁3个月。面色苍黄2个月，原可独走，现站立不稳，生后母乳喂养，未添加辅食。查体：表情呆滞，四肢抖动，舌苔薄，呈地图状。血常规：Hb88g/L，RBC2.1×10¹²/L。最适当的治疗是
A. 康复治疗
B. 肌注维生素B₁₂
C. 低苯丙氨酸饮食
D. 肌注维生素D
E. 口服铁剂

正确答案：B。肌注维生素B₁₂

解析：患儿1岁3个月，生后母乳喂养，未添加辅食（维生素B12摄入量不足），面色苍黄，站立不稳，表情呆滞，四肢抖动，舌苔薄，呈地图状（巨幼贫患儿典型临床表现），血常规：Hb88g/L，RBC2.1×10¹²/L（提示贫血）。根据患儿年龄、临床表现、体征及血常规，最可能的诊断是营养性巨幼细胞性贫血。该类患儿治疗除注重营养，及时添加辅食，防止感染等一般治疗外，应及时补充维生素B12及叶酸，对有神经精神症状患儿，以肌注补充维生素B12为主，单补充叶酸（口服）反而加重病情。